差示扫描量热法的缩写是
A. DTA
B. DSC
C. TGA
D. ODS
E. RSD

正确答案：B。DSC